可杀灭细菌繁殖体，常用于餐具及一些医疗器械的消毒的方法是
A. 焚烧法
B. 烧灼法
C. 巴氏消毒法
D. 煮沸法
E. 高压蒸汽灭菌法

正确答案：D。煮沸法

解析：煮沸法：在1个大气压下，将水煮沸（100℃）5分钟，可杀灭细菌繁殖体，如加入2%碳酸钠，可提高沸点至105℃并可防锈，常用于餐具及一些医疗器皿的消毒。掌握“消毒与灭菌”知识点。